甲型病毒性肝炎的主要传播途径是
A. 体液传播
B. 密切接触传播
C. 粪-口途径传播
D. 母婴传播
E. 输血传播

正确答案：C。粪-口途径传播

解析：甲型病毒性肝炎的主要传播途径是粪-口途径（C对）。乙型肝炎的传播途径：①母婴传播（D错）；②血液、体液传播（A错）；③其他。丙型肝炎的传播途径：①输血（E错）及血制品；②注射、针刺、器官移植、骨髓移植、血液透析；③生活密切接触（B错）；④性传播；⑤母婴传播。丁肝与乙肝传播途径相似。戊肝与甲肝传播途径相似相似。